以下哪几条具被动扩散特征
A. 不消耗能量
B. 有结构和部位专属性
C. 由高浓度向低浓度转运
D. 借助载体进行转运
E. 有饱和状态

正确答案：A、C。不消耗能量；由高浓度向低浓度转运

解析：本题考查药物的转运方式。被动转运的特点包括：①不消耗能量（A对）；②不需要载体（D错），没有结构和部位专属性（B错）；③从高浓度区域向低浓度区域的转运（C对）；④无饱和现象（E错）等。